腹部闭合性损伤患者伴休克，腹部穿刺抽出不凝血。应采取的治疗原则是
A. 输血补液，并用升压药物抗休克
B. 抗休克待血压好转后手术
C. 先抗休克后手术
D. 抗休克同时手术
E. 用大量止血药物不手术

正确答案：D。抗休克同时手术

解析：患者已有休克表现，腹部穿刺抽出不凝血，提示腹腔内实质性器官破裂大出血，病情较凶险，因此，应采取的治疗是抗休克治疗的同时手术（D对BC错）。输血、补液、应用升压药等（A错）保守治疗可暂时缓解休克症状，但不能从根本上解决引起失血的原因。患者腹腔脏器破裂伴休克，应用止血药物难以控制出血，应及时手术（E错）。